所谓疾病的“病死率”是指
A. 10万人口的粗死亡率
B. 某病的病因死亡专率
C. 任何疾病的死亡数
D. 该疾病人中死亡者的百分比
E. 某病的死亡数占全死因总死亡数的比例

正确答案：D。该疾病人中死亡者的百分比

解析：本题考查病死率的概念。病死率表示一定时期内因某病死亡者占该病病人的比例（D对ABCE错），表示某病病人因该病死亡的危险性。